医院感染的来源
A. 环境感染
B. 内源性感染
C. 交叉感染或外源性感染
D. A+C
E. A+B+C

正确答案：E。A+B+C

解析：医院感染的来源：①交叉感染或外源性感染；②环境感染；③内源性感染。掌握“医院感染及细菌的致病性”知识点。